关于牙周病支持治疗即维护期，哪一项不正确
A. 维护治疗与愈后密切相关
B. 一般每3～6个月复查一次
C. 复查间隔根据患者具体情况而定
D. 维护治疗只针对口腔卫生差的人
E. 复查时应进行牙周全面检查

正确答案：D。维护治疗只针对口腔卫生差的人

解析：牙周支持治疗，也称维护期，这是正规的牙周系统性治疗计划中不可缺少的部分，它是牙周疗效得以长期保持的先决条件。在第一阶段治疗结束后，无论是否需要手术和修复治疗，维护期即应开始，其内容包括以下方面：定期复查：根据患者剩余牙的病情以及菌斑控制的好坏，确定复查的间隔期。治疗刚结束时，复查应稍密集些，如1～2个月，以了解疗效保持情况。若病情稳定后，可酌情延长间隔期。复查时间应根据每位患者的情况而确定。一般每3～6个月复查一次，约1年拍X线片，监测和比较牙槽骨的变化。复查内容：检查患者菌斑控制情况及软垢、牙石量，牙龈炎症（探诊后有无出血）及牙周袋深度、附着水平，牙槽骨高度、密度及形态，咬合情况及功能、牙松动度，危险因素（如吸烟、全身疾病）的控制情况等。掌握“慢性牙周炎的病因，表现诊断及预后”知识点。